对脂肪消化力最强的是
A. 唾液
B. 胃液
C. 胆汁
D. 胰液
E. 小肠液

正确答案：D。胰液